固有鼻腔的描述，哪项错误
A. 黏膜可分为嗅区和呼吸部
B. 呼吸部含丰富的鼻腺
C. 鼻腺有湿润空气的作用
D. 鼻黏膜与鼻旁窦鼻黏膜与鼻旁窦黏膜不相延续
E. 嗅区内有接受气味刺激的嗅细胞

正确答案：D。鼻黏膜与鼻旁窦鼻黏膜与鼻旁窦黏膜不相延续

解析：鼻黏膜与鼻旁窦鼻黏膜与鼻旁窦黏膜相延续（D错，为本题正确答案）。鼻黏膜可分为嗅区和呼吸部（A对）。鼻黏膜呼吸部含丰富的鼻腺（B对）。鼻腺有湿润空气的作用（C对）。鼻黏膜嗅区内有接受气味刺激的嗅细胞（E对）。